穿山甲性微寒，除治闭经、癥瘕外，又治
A. 虫积腹痛
B. 疮疡不敛
C. 中风瘫痪
D. 赤白痢疾
E. 蛇虫咬伤

正确答案：C。中风瘫痪

解析：本题考查的是穿山甲的主治病证。穿山甲性微寒，除治闭经、癥瘕外，又治中风瘫痪（C对）。穿山甲：【主治病证】（1）瘀血闭经，癥瘕痞块，跌打肿痛。（2）痹痛拘挛，中风瘫痪，麻木拘挛。（3）乳汁不下。（4）痈肿疮毒，瘰疬痰核。干漆：【主治病证】（1）闭经，癥瘕积聚。（2）虫积腹痛（A错）。血竭：【主治病证】（1）瘀血闭经、痛经，产后瘀阻腹痛。（2）癥瘕痞块，胸腹刺痛。（3）跌打损伤，瘀血肿痛。（4）外伤出血，溃疡不敛（B错）。刘寄奴：【主治病证】（1）闭经，产后腹痛，癥瘕。（2）跌打损伤，创伤出血。（3）食积腹痛，赤白痢疾（D错）。五灵脂：【主治病证】（1）血滞痛经、闭经，产后瘀阻腹痛，胸胁脘腹刺痛。（2）瘀滞崩漏。（3）蛇虫咬伤（E错）。